脾肾阳虚，水饮内停，常见的舌形是
A. 胖大舌
B. 齿痕舌
C. 瘦薄舌
D. 裂纹舌
E. 芒刺舌

正确答案：A。胖大舌

解析：本题考查的是望舌形。脾肾阳虚，水饮内停，常见的舌形是胖大舌（A对）。望舌形，以观察舌质的荣枯老嫩以及形体的异常变化为主。首先应注意舌体的荣枯老嫩，舌体明润者为荣，说明津液充足；舌体干瘪者为枯，说明津液已伤；舌质纹理粗糙，形色坚敛苍老者为老，多属实证、热证；纹理细腻，形色浮胖娇嫩者为嫩，多属虚证、寒证。同时还要观察舌体的胖瘦、大小，有无裂纹、齿痕及芒刺等五种常见的形体变化情况。①胖大舌：较正常舌体胖大，为胖大舌。有胖嫩与肿胀之分。若舌体胖嫩，色淡，多属脾肾阳虚、津液不化、水饮痰湿阻滞所致；如舌体肿胀满口，色深红，多是心脾热盛；若舌肿胖，色青紫而暗，多见于中毒。②瘦薄舌（C错）：舌体瘦小而薄，称为瘦薄舌，是阴血亏虚、舌体不充之象。瘦薄而色淡者，多是气血两虚；瘦薄而色红绛且干，多是阴虚火旺、津液耗伤所致。③裂纹舌（D错）：舌面上有明显的裂沟，称为裂纹舌，多由阴液亏损不能荣润舌面所致。若舌质红绛而有裂纹，多属热盛津伤、阴精亏损；舌色淡白而有裂纹，常是血虚不润的反映。其中正常人亦有裂纹舌者，在临床上无诊断意义。④齿痕（B错）：舌体的边缘见牙齿的痕迹，即为齿痕舌。多因舌体胖大而受齿缘压迫所致，故齿痕舌常与胖大舌同见，多属脾虚。若舌质淡白而湿润，多为脾虚而寒湿壅盛。⑤芒刺（E错）：舌乳头增生、肥大，高起如刺，摸之棘手，称为芒刺。若芒刺干燥，多属热邪亢盛，且热愈盛则芒刺愈多。根据芒刺所生部位，可分辨邪热所在脏腑，如舌尖有芒刺，多属心火亢盛；舌边有芒刺，多属肝胆火盛；舌中有芒刺，多属胃肠热盛。